对诊断梅毒无特异性的检查是
A. 螺旋体检查
B. 华氏试验
C. 康氏试验
D. 絮状沉淀玻片法
E. 外周血常规白细胞计数

正确答案：E。外周血常规白细胞计数

解析：本题考查梅毒。对诊断梅毒无特异性的检查是外周血常规白细胞计数（E对）。诊断梅毒依据：1.有不洁性交史或有明确的接触梅毒螺旋体污染物的病史，或有胎传的病史；2.各期梅毒的典型与主要的临床表现，例如硬下疮、梅毒疹等；3.全身及生殖器官体格检查，重点检查观察硬下疮、横疮、梅毒疹、结节性梅毒疹、梅毒瘤等病损，以及涉及到骨、心脏、神经等有关脏器梅毒的检查；4.实验室检查。ABCD四个选项书中未明确指出用于何种检查，为干扰选项。